股骨干下1/3骨折时骨折端移位方向是
A. 近折端向前上移位，远折端向前方移位
B. 近折端向前上移位，远折端向后方移位
C. 近折端向后上移位，远折端向前方移位
D. 近折端向后下移位，远折端向内侧移位
E. 近折端向后下移位，远折端向前方移位

正确答案：B。近折端向前上移位，远折端向后方移位

解析：股骨干骨折可分为上1/3、中1/3和下1/3骨折。其中上1/3骨折时，近折端向前、外及外旋方向移位，远折端向内、后方移位或向近端移位；中1/3骨折时，骨折向外成角；下1/3骨折时，近折端向前上移位，远折端向后方移位，形成短缩畸形（B对）。